大量的研究证实，躯干与下肢的比例主要取决于
A. 种族遗传
B. 营养状况
C. 体育锻炼
D. 家族遗传
E. 地理环境与季节

正确答案：A。种族遗传

解析：本题考查影响体格生长的因素。影响体格生长的因素：1.遗传因素；2.环境因素。遗传因素主要受家族和种族影响，成年身高在很大程度上取决于家族遗传。个体的体型、躯干和四肢长度比例受种族（A对BCDE错）影响较大。